治疗血虚，常配伍补气药。其根据是
A. 气能生血
B. 气能摄血
C. 气能行血
D. 血能载气
E. 血能生气

正确答案：A。气能生血

解析：气能参与、促进血液的化生。血液的化生以营气、津液、肾精为物质基础，每一个环节都离不开相应的脏腑之气的推动和激发作用，这是血液生成的动力。有了血液生成的动力，还需要一定的物质基础，即营气与津液入脉化血，使血量充足。因此，气充盛化生血液的的功能增强，补气药配合补血药使用，取得良好的疗效，即是源于气能生血的理论（A对BCDE错）。